男，70岁。乏力、腰痛半个月。既往体健。查体：轻度贫血貌，第2～4腰椎局部压痛。实验室检查：Hb80g/L，WBC5.6×10⁹/L，Plt156×10⁹/L；血清总蛋白108g/L，白蛋白30g/L，血肌酐177umol/L；骨髓细胞学检查示骨髓中异常浆细胞占0.45；腰椎X线片示第2腰椎压缩性骨折。该患者疾病最可能的类型是
A. 不分泌型
B. IgG型
C. 轻链型
D. IgE型
E. IgD型

正确答案：B。IgG型

解析：患者诊断为多发性骨髓瘤，多发性骨髓瘤按血清M蛋白成分的特点可分为IgG、IgA、IgD、IgM、IGE型、轻链型、非分泌型以及双克隆或多克隆免疫球蛋白型，其中IgG型最常见，故该患者最可能的类型是IgG型（B对）。不分泌型（A错）、轻链型（C错）、IgE型（D错）、IgD型 （E错）都是多发性骨髓瘤的类型，但不如IgG型常见。